有关黏膜免疫的功能及应用描述不正确的是
A. 抗感染
B. 参与超敏反应
C. 建立和保证食物免疫耐受
D. 维持肠道免疫耐受
E. 打破免疫耐受

正确答案：E。打破免疫耐受